女性尿路感染最常见的感染途径是
A. 淋巴道感染
B. 血行感染
C. 医源性感染
D. 上行感染
E. 直接感染

正确答案：D。上行感染

解析：女性尿道较短（约4cm）而宽，距离肛门较近，开口于阴唇下方是女性容易发生尿路感染的重要因素，上行感染是指病原菌经尿道上行至膀胱，甚至输尿管、肾盂引起的感染，约占尿路感染的95%，女性的解剖生理因素导致易发生尿路感染，上行感染途径最常见（D对）（P491）。盆腔和下腹部的器官感染时，病原菌可从淋巴道感染（A错）泌尿系统，但罕见（P492）。血行感染（B错）是指病原菌通过血运到达肾脏和尿路其他部位引起的感染，此种感染途径少见，不足2%（P491）。医源性感染（C错）是指导尿或留置导尿、膀胱镜和输尿管镜检查等导致尿路粘膜损伤，如将细菌带入泌尿道，易引起尿路感染，医源性感染虽为泌尿道感染的途径之一，但不是最常见（P492）。直接感染（E错）指泌尿系统周围器官、组织发生感染时，病原菌偶直接侵入到泌尿系统导致感染，不是最近常见的感染途径（P492）。